女，65岁。摔伤致右髋关节疼痛，功能障碍。X线片示右股骨颈头下骨皮质连续性中断，Pauwells角60°。该股骨颈骨折属于
A. 不完全骨折
B. 关节外骨折
C. 外展骨折
D. 稳定性骨折
E. 内收骨折

正确答案：E。内收骨折

解析：老年女性患者，摔伤后右髋关节疼痛、功能障碍（提示可能为股骨颈骨折），X线片示右股骨颈头下骨皮质连续性中断，Pauwels角60°（Pauwels角为远端骨折线与两侧髂嵴连线的夹角，外展型骨折Pauwels角＜30°，内收型骨折Pauwels角＞50°），结合患者病史、临床表现及实验室检查，患者应诊断为右股骨颈内收型骨折（E对C错）。内收型骨折属不稳定性骨折，外展型骨折属稳定性骨折（D错）。髋关节囊将整个股骨颈包裹在其中，因此股骨颈骨折属于关节内骨折（B错）。不完全骨折指骨的完整性和连续性部分中断，完全骨折指骨的完整性和连续性全部中断，患者X线片示右股骨颈头下骨皮质连续性中断，应为完全骨折（A错）。